男，48岁。近半年来记忆力渐差，刚讲过的话就忘记了。把别人做的事情说成是自己做的，且不认识家人，有时在深夜看到屋里有人影晃动。大量饮酒10年。最可能的诊断是
A. 酒精性妄想综合征
B. 酒精性幻觉症
C. 柯萨可夫综合征
D. Wernicke脑病
E. 酒精性痴呆

正确答案：C。柯萨可夫综合征

解析：患者中青年男性，有长期大量饮酒史，近半年记忆力渐差（记忆障碍），把别人做的事说成是自己做的（虚构），且不认识家人（定向障碍），有时在深夜看到屋里有人影晃动（幻觉），根据患者的病史及症状，诊断考虑为酒精所致精神障碍，Korsakoff综合征（C对）。酒精性妄想综合征（A错）主要表现为意识清晰的情况下的妄想状态，特别是嫉妒妄想。酒精性幻觉症（B错）主要表现为意识清晰状态下出现生动、持续的视听幻觉，而该患者只在夜间看到人影晃动。Wernicke脑病（D错）主要表现为眼球震颤、眼球不能外展和明显的意识障碍，是由维生素B1缺乏所致。酒精性痴呆（E错）虽有记忆减退，失认等表现，但该患者并没有出现持续的智力减退。